用来说明疾病对人群生命威胁程度的指标是
A. 发病率
B. 死亡率
C. 患病率
D. 罹患率
E. 病死率

正确答案：E。病死率

解析：本题考查病死率的应用。病死率（E对ABCD错）表示一定时期内因某病死亡者占该病病人的比例，表示某病病人因该病死亡的危险性。它可用来说明疾病对人群生命威胁程度。